有关正中关系的定义中，说法错误的是
A. 下颌适居正中
B. 髁状突处于关节窝的后位
C. 在适当的垂直距离下
D. 它的最后位是下颌后退接触位
E. 是一个功能性的下颌位

正确答案：E。是一个功能性的下颌位

解析：本题考查后退接触位。下颌在正中关系时可做铰链运动，即单纯的转动而无滑动，在此铰链运动范围内，下颌对上颌的关系都是正中关系。因此正中关系是一个范围，而不是一个功能性的下颌位（E错，为本题的正确答案）。正中关系指下颌不偏左、不偏右，适居正中（A对），髁状突处于关节窝的后位（B对），在适当的垂直距离下（C对），下颌骨对上颌骨的位置关系。它是稳定而可重复性的位置，其最后位是下颌后退接触位（D对），如果迫使下颌再向后退，则会由于附着在下颌骨上的肌肉受拉，髁状突后方的软组织受压而感到不适。